主要是用于去除医疗器械内小的碎屑
A. 手工清洗
B. 清洗机清洗
C. 超声波清洗
D. 消毒
E. 灭菌

正确答案：C。超声波清洗

解析：超声波清洗：结构复杂、缝隙多的器械应当采用超声波清洗。超声波主要是用于去除医疗器械内小的碎屑，为此超声清洗前须先初步清洗以除去大的污物。超声清洗时间宜为3～5分钟，可根据器械污染情况适当延长清洗时间，不宜超过10分钟。在使用前应让机器运转5～10分钟以排出溶解的空气，机器内加酶可提高超声清洗的效率。掌握“口腔器械的消毒与灭菌及医疗废物处理”知识点。